有关硝苯地平降压时伴随状况的描述，下列哪项是正确的
A. 心率不变
B. 心排血量下降
C. 血浆肾素活性增高
D. 尿量增加
E. 肾血流量降低

正确答案：C。血浆肾素活性增高

解析：硝苯地平属于二氢吡啶类钙拮抗药，对血管有较高的选择性，引起小动脉平滑肌松弛，动脉血管扩张，外周阻力下降，血压降低，用于轻、中、重度各型高血压，对高血压伴有心绞痛、糖尿病、脑血管病、肾功能不良等并发症疗效好，因降压时反射性使交感神经活性增加，引起心率增快（A错）、心排出量增加（B错）、血浆肾素活性增高（C对），故常与利尿药、β受体阻断药等合用。钙通道阻滞剂具有轻度排钠利尿作用，一般不引起水钠潴留（D错）。硝苯地平在降压的同时，可改善心、脑、肾等重要器官的血流量（E错）。